中风的病理基础是
A. 风火痰瘀
B. 气血逆乱
C. 心肝火旺
D. 肝阳上亢
E. 肝肾阴虚

正确答案：E。肝肾阴虚

解析：中风形成的基本病机总属阴阳失调，气血逆乱。风火痰瘀为其病理因素，是发病的标（A错）。肝肾阴虚为其致病之本，是其病理基础。在肝肾阴虚的基础上，若饮食不节，情志过极，劳欲过度等的诱发下，致瘀血阻滞，痰热内生，心火亢盛，肝阳暴亢，风火相煽，气血逆乱，上冲犯脑而成中风，是以肝肾阴虚为本，故中风的病理基础为肝肾阴虚（E对BCD错）。